大鼠急性经口染毒，为了准确地将受试物给入消化道内，多采用
A. 喂饲
B. 灌胃
C. 吞咽胶囊
D. 鼻饲
E. 饮水

正确答案：B。灌胃